血吸虫病流行区的一次调查中，查得93例急性血吸虫病人有如下的疫水接触史：游泳52人，割湖草30人，插秧6人，放牧3人，洗衣2人，由此得出游泳是最危险的接触方式，是否正确
A. 是
B. 不是，应了解他们的既往史
C. 不是，因没设对照
D. 不是，因未作统计学显著性检验
E. 不是，因所做比较不是以率为基础的

正确答案：E。不是，因所做比较不是以率为基础的

解析：本题考查率的应用。当进行危险度评价和比较时，当总体未知时，不应采用绝对数进行比较，而是需要用率作比较。本题中进行比较不是以率为基础（E对ABCD错），因此该结论不合理。